儿童易发生的伴有神经血管损伤，常出现肘内翻或外翻的骨折
A. 肱骨髁上骨折
B. 肱骨干骨折
C. 肱骨近端骨折
D. 双前臂骨折
E. 桡骨远端骨折

正确答案：A。肱骨髁上骨折

解析：在肱骨髁内、前方，有肱动脉、正中神经经过。在神经血管束的浅面有坚韧的肱二头肌腱膜，后方为肱骨，一旦发生骨折，神经血管容易受到损伤。在肱骨髁的内侧有尺神经，外侧有桡神经，均可因肱骨髁上骨折的侧方移位而受到损伤。在儿童期，肱骨下端有骨骺，若骨折线穿过骺板，有可能影响骨骺的发育，因而常出现肘内翻或外翻畸形（A对）。